《素问·举痛论》认为劳力过度可导致的是
A. 气上
B. 气泄
C. 气收
D. 气耗
E. 气下

正确答案：D。气耗

解析：过度劳力会导致气喘，汗出过多，使气耗散，其次过度劳力会损伤内脏的精气，导致脏气虚少，功能减退。由于肺为气之主，脾为生气之源，故劳力太过尤易耗伤脾肺之气导致气耗（D对）；《素问· 举痛论》：余知百病生于气也。怒则气上（A错），喜则气缓，悲则气消，恐则气下（E错），寒则气收（C错），炅则气泄（B错），惊则气乱，劳则气耗，思则气结。